大环内酯类对下述哪类细菌无效
A. G⁺菌
B. G⁻球菌
C. 大肠杆菌、变形杆菌
D. 军团菌
E. 衣原体、支原体

正确答案：C。大肠杆菌、变形杆菌